下列关于TNF-α因子描述不正确的是
A. 高活性的促炎症细胞因子
B. 可促进巨噬细胞的吞噬功能
C. 也称淋巴毒素
D. 能杀伤肿瘤细胞
E. 可直接作用下丘脑体温调节中枢引起发热

正确答案：C。也称淋巴毒素

解析：肿瘤坏死因子（TNF）是能使肿瘤发生出血性坏死的细胞因子。TNF分为IFN-α和IFN-β，IFN-γ也称淋巴毒素（LT）。TNF-α是高活性的促炎症细胞因子；可促进巨噬细胞的吞噬功能；能杀伤肿瘤细胞；可直接作用下丘脑体温调节中枢引起发热。全身高水平的IFN-α可引起代谢紊乱乃至恶病质，也可引起脓毒血症休克。掌握“细胞因子及受体”知识点。